患者因楔状缺损，复合树脂充填后一直冷热刺激痛，复诊。查：左上6颊面复合树脂充填物，叩（-），冷测疼痛，去除刺激可缓解，该患者处理应为
A. 观察
B. 脱敏
C. 去除旧充填体，复合树脂重新充填
D. 去除旧充填体，氧化锌丁香油糊剂安抚
E. 牙髓治疗

正确答案：D。去除旧充填体，氧化锌丁香油糊剂安抚

解析：患者因楔状缺损，复合树脂充填后一直冷热刺激痛，复诊。查：左上6颊面复合树脂充填物，叩（-），冷测疼痛，去除刺激可缓解，该患者处理应为去除旧充填体，氧化锌丁香油糊剂安抚（D对）。根据病例描述，患者因楔状缺损，复合树脂充填后一直冷热刺激痛，检查见左上6颊面复合树脂充填物，叩（-），冷测疼痛，去除刺激可缓解，可考虑是由于患者楔状缺损较深，复合树脂直接充填后刺激牙髓，导致的牙髓激惹症状，根据冷测的结果，可考虑患牙为可复性牙髓炎，应去除旧充填体，氧化锌丁香油糊剂安抚，待牙髓恢复正常后再用重新垫底充填（C错）。观察适用于充填术后牙髓激发痛症状较轻，可自行缓解者（A错）。脱敏主要用于牙本质敏感的治疗，该患者冷热刺激痛是由可复性牙髓炎引起的，用脱敏的方法并不能缓解症状（B错）。牙髓治疗用于不可复性牙髓炎的治疗，患牙为可复性牙髓炎，不必进行牙髓治疗（E错）。